缺乏维生素C对牙齿发育的影响是
A. 成牙本质细胞变性不能形成正常牙本质
B. 成釉细胞不能分化成高柱状细胞
C. 钙盐在牙中沉淀迟缓
D. 影响牙周膜形成
E. 影响釉质矿化

正确答案：A。成牙本质细胞变性不能形成正常牙本质

解析：本题考查维生素C缺乏对牙齿发育的影响。缺乏维生素C对牙齿发育的影响是成牙本质细胞变性不能形成正常牙本质（A对）。维生素A缺乏时，造釉器不能分化成高柱状细胞而蜕变成扁平细胞，使釉质发育不全（B错）。维生素C缺乏，影响牙本质中的胶原代谢。维生素D缺乏，钙盐在牙中沉淀迟缓（C错）。无机盐缺乏，影响釉质矿化沉积（E错）。